成品需测定乙醇量的有
A. 浸膏剂
B. 酊剂
C. 中药合剂
D. 流浸膏剂
E. 药酒

正确答案：B、D、E。酊剂；流浸膏剂；药酒

解析：本题考查剂型的稳定性试验考察项目。成品需测定乙醇量的有酊剂（B对）、流浸膏剂（D对）、药酒（E对）。酊剂【稳定性试验考察项目】性状、鉴别、乙醇量、甲醇量、含量测定、微生物限度检查。流浸膏【稳定性试验考察项目】性状、鉴别、乙醇量、甲醇量、含量测定、微生物限度检查。酒剂【稳定性试验考察项目】性状、鉴别、乙醇量、甲醇量、总固体、含量测定、微生物限度检查。浸膏剂（A错）【稳定性试验考察项目】性状、鉴别、含量测定、微生物限度检查。合剂（C错）【稳定性试验考察项目】性状（澄明度）、鉴别、相对密度、pH值、含量测定、微生物限度检查。